治疗脾胃虚寒，脘腹冷痛，兼寒饮伏肺，咳嗽气喘，痰多清稀者，应首选
A. 附子
B. 肉桂
C. 干姜
D. 细辛
E. 高良姜

正确答案：C。干姜

解析：干姜辛热燥烈，主入脾胃而长于温中散寒，健运脾阳，治脾胃虚寒，脘腹冷痛；入肺经，善于温肺散寒化饮，治寒饮喘咳，形寒背冷，痰多清稀之证（C对）。附子（A错）上助心阳，中温脾阳，下补肾阳，为回阳救逆第一品药。肉桂（B错）辛甘大热，能补火助阳，益阳消阴，作用温和持久，为治命门火衰之要药。细辛（D错）辛温发散，芳香透达，入肺经长于解表散寒，祛风止痛，宜于外感风寒，头身疼痛较甚者。高良姜（E错）辛散温通，能散寒止痛，为治胃寒脘腹冷痛之常用药。